乳牙根尖病治疗方法为
A. 直接盖髓
B. 活髓切断术
C. 干髓术
D. 根管治疗术
E. 间接盖髓术

正确答案：D。根管治疗术

解析：本题考查乳牙牙髓病及根尖周病诊断及治疗。根管治疗术（D对）：是通过根管预备和药物消毒去除感染物质对根尖周组织的不良刺激，用可吸收的充填材料充填根管，促进根尖周病愈合，是保留牙髓坏死或根尖周感染的乳牙最后的治疗手段。适应证：牙髓炎症涉及根髓，不宜行牙髓切断术的患牙。牙髓坏死及根尖周炎而具保留价值的乳牙。